进行地表水表层水采样时，其采样深度一般要在水下
A. 0.5m以下
B. 0.2～0.5m
C. 0.2m以上
D. 0.5～1m
E. 无特殊要求

正确答案：B。0.2～0.5m

解析：本题考查地表水表层水的采样深度。进行地表水表层水采样时，其采样深度一般要在水下0.2～0.5m（B对ACDE错）。